提呈抗原
A. NK细胞
B. B细胞
C. 肥大细胞
D. 细胞毒性T淋巴细胞
E. 浆细胞

正确答案：B。B细胞

解析：B细胞（B对）通过抗体发挥特异性体液免疫功能，同时也是重要的抗原提呈细胞，并参与免疫调节。NK细胞（自然杀伤细胞）（A错）参与机体抗肿瘤、抗病毒感染和免疫调节。肥大细胞（C错）通过脱颗粒可释放和合成一系列炎性介质（组胺、白三烯、前列腺素D2等）和促炎细胞因子（IL-1、IL-4、IL-8和TNF等）引发炎症反应，从而在机体抗感染、抗肿瘤和免疫调节中发挥重要作用。细胞毒性T淋巴细胞（D错）为一种特异T细胞，专门分泌各种细胞因子参与免疫作用，对某些病毒、肿瘤细胞等抗原物质具有杀伤作用，与自然杀伤细胞构成机体抗病毒、抗肿瘤免疫的重要防线。浆细胞（E错）具有合成、贮存抗体即免疫球蛋白的功能，参与体液免疫反应。